实践中有些资料的总体分布类型未知，或分布类型已知但不对称，再或者变量可能无法精确测量等，这些特点不符合前面所介绍的统计方法的适用条件，属于
A. 参数检验
B. 正态分布检验
C. 偏态分布检验
D. 任意分布检验
E. 卡方检验

正确答案：D。任意分布检验

解析：实践中有些资料的总体分布类型未知，或分布类型已知但不对称，再或者变量可能无法精确测量等，这些特点不符合前面所介绍的统计方法的适用条件，属于非参数检验，或称任意分布检验。掌握“秩和检验、直线回归和线性分析”知识点。